攻膜复合物是
A. C3
B. C3bBb
C. C5b67
D. C5b6789n
E. C4b2b

正确答案：D。C5b6789n